女，33岁，产后无乳，闭经4年，昏迷一天。查体：体温35度，P90次/分，血压80/40，面色苍白，腋毛阴毛缺失。血K⁺4.5mmol/L，Na⁺126.4mmol/L，血糖3.1mmol/L，该患者最可能的病因为
A. 垂体危象
B. 垂体卒中
C. 低血糖昏迷
D. 黏液性水肿
E. Addison病

正确答案：A。垂体危象

解析：患者产后（此为腺垂体功能减退症的病因之一）出现无乳、闭经、阴毛、腋毛缺失（性腺功能减退表现），低钠、低血压（肾上腺功能减退表现），面色苍白（ACTH缺乏），考虑腺垂体功能减退。查体：T35℃，BP80/40mmHg，血糖3.1mmol/L，昏迷（垂体危象的表现）。结合患者的病史、症状、体征，考虑垂体危象（A对）。垂体卒中（B错）为腺垂体功能减退的病因之一。低血糖昏迷（C错）发作时血糖1.8-2.2mmol/L（本例血糖3.1mmol/L）。黏液性水肿（D错）是甲状腺功能减退症病情加重的严重状态。Addison病（E错）是原发性慢性肾上腺皮质功能减退症，最具特征性为全身皮肤色素加深。